关于髋臼的描述正确的是
A. 又名髋臼窝
B. 由髂、耻、坐三骨围成
C. 呈完整的杯状
D. 整个表面都是关节面
E. 中央凹陷的部分称股骨头凹

正确答案：B。由髂、耻、坐三骨围成

解析：髋臼由髂、坐、耻三骨的体合成（B对）。髋臼窝内呈半月形（C错）的关节面称月状面（D错）。窝中央的凹陷部分称髋臼窝（AE错）。